药材呈扁圆柱形，肉质，稍弯曲的是
A. 益母草
B. 淫羊藿
C. 茵陈蒿
D. 肉苁蓉
E. 广金钱草

正确答案：D。肉苁蓉